药师审核麻醉药品处方时，应逐项审核。不属于规范性审核内容的是
A. 处方医师是否有麻醉药品处方权
B. 处方用量是否严格执行国家有关规定
C. 是否有病历记录
D. 是否写明临床诊断
E. 处方字迹是否清晰

正确答案：A。处方医师是否有麻醉药品处方权

解析：本题考查处方规范性审核。不属于规范性审核内容的是处方医师是否有麻醉药品处方权（A错，为本题正确答案）。审核麻醉药品开方医师是否具有相应处方权属于处方合法性审核。属于规范性审核内容的是处方用量是否严格执行国家有关规定（B对）、是否有病历记录（C对）、是否写明临床诊断（D对）、处方字迹是否清晰（E对）。